助消化药胰酶的禁用人群
A. 高血压者
B. 高钾血症者
C. 乳酸血症者
D. 胰腺炎早期者
E. 闭角型青光眼

正确答案：D。胰腺炎早期者

解析：本题考查助消化药胰酶的禁用人群。助消化药胰酶的禁用人群主要有孕妇、处于哺乳期的妇女、患有急性胰腺炎的患者（D错，为本题正确答案）。